某人进行了下列疫苗试验，随机选择1000人，注射疫苗后，随访10年，接种者中80%未患该病，此疫苗效果
A. 很好
B. 得不出结论，因为无注射疫苗的对照
C. 不是很有效，因为尚有20%患病
D. 无肯定结论，因为未做统计学检验
E. 该病疾病的发生率是20%

正确答案：B。得不出结论，因为无注射疫苗的对照